尿道前列腺部
A. 是男尿道三部中管腔最宽的一段
B. 此段前壁上有纵行的尿道嵴，嵴之中部膨大处称精阜
C. 精阜中央之孔为射精管之开口
D. 尿道球腺，前列腺的排泄管均开口于此段
E. 上述全部正确

正确答案：A。是男尿道三部中管腔最宽的一段

解析：男性尿道三段中最宽的一段（A错）为尿道海绵体内的尿道球部。尿道前列腺部其后壁（B错）有一纵行隆起称为尿道嵴。精阜中央小凹为前列腺小囊，两侧（C错）为射精管口。仅前列腺输出管的开口（D错）于此段。答案选A，但本题无正确答案。